Th1细胞激活Mφ可通过
A. 诱生IFN-γ激活Mφ
B. CD40L与Mφ表面的CD40分子结合向Mφ提供激活信号
C. 与Mφ提呈的特异性抗原结合可诱导Mφ激活
D. 上列A和B两项
E. 上列A、B和C三项

正确答案：D。上列A和B两项